应用时患者应进行水化利尿的药物是
A. 庆大霉素
B. 苯妥英钠
C. 维拉帕米
D. 葡萄糖酸钙
E. 顺铂

正确答案：E。顺铂

解析：本题考查药源性疾病。肾脏毒性是顺铂（E对）最常见又严重的毒性反应，应用时患者应进行水化利尿，降低顺铂所致肾小管坏死的发生率。庆大霉素（A错）不得静脉注射，直接静脉注射则易引起呼吸抑制。苯妥英钠（B错）神经系统不良反应与剂量相关。维拉帕米（C错）静脉推注可致低血压。葡萄糖酸钙（D错）静脉给药时可能出现全身发热感，静脉速度过快时，可产生心律失常，恶心和呕吐。